根据《中共中央、国务院关于深化医药卫生体制改革的意见》，基本医疗卫生制度的主要内容不包括
A. 公共卫生服务体系
B. 医疗服务体系
C. 医疗保障体系
D. 药品供应保障体系
E. 医疗卫生人才体系

正确答案：E。医疗卫生人才体系

解析：本题考察基本医疗卫生制度。基本医疗卫生制度主要由医药卫生四大体系、八项支撑组成。四大体系是指建设公共卫生服务体系、医疗服务体系、医疗保障体系和药品供应保障体系，不包括医疗卫生人才体系（E错，为本题正确答案）。